确诊快速进展性牙周炎时需先排除的因素不包括
A. 是否有严重的错（牙合）
B. 年龄是否在青春期到25岁之间
C. 是否接受过不正确的正畸治疗
D. 有无明显的局部促进因素如食物嵌塞
E. 是否伴随有全身系统疾病如糖尿病

正确答案：B。年龄是否在青春期到25岁之间

解析：本题考查确诊快速进展性牙周炎时需先排除的因素。旧分类法中的快速进展性牙周炎现已归为侵袭性牙周炎。侵袭性牙周炎又分为局限型和广泛型。临床上常以全口大多数牙的重度牙周破坏和年龄在35岁以下（不仅仅指在青春期到25岁之间）（B错，为本题的正确答案）作为诊断广泛型侵袭性牙周炎的标准。 因为严重的错（牙合）（A对）导致咬合创伤；接受过不正确的正畸治疗（C对）；食物嵌塞等局部促进因素（D对）；全身系统疾病如糖尿病等因素（E对）均可加速牙周炎的病程，所以确诊快速进展性牙周炎时需先排除以上因素。